易水解的药物有
A. 苷类
B. 含酚羟基的
C. 酰胺类
D. 挥发油类
E. 酯类

正确答案：A、C、E。苷类；酰胺类；酯类

解析：本题考查的是易水解的药物类型。易水解的药物有苷类（A对）、酰胺类（C对）、酯类（E对）。易水解的药物类型：①酯类药物：具有酯键结构的药物较易水解，相对分子量小的脂肪族酯类极易水解，几乎无法制成稳定的液体制剂。酯类药物制成水溶液时要特别注意pH的调节。一般而言，溶液碱性愈强，水解愈快，如穿心莲内酯在pH7时内酯环水解极其缓慢，而在偏碱性溶液中则水解加快。②酰胺类药物：一般较酯类药物难水解，如青霉素等。③苷类药物：在酶或酸碱的作用下产生水解反应，水解的难易程度与构成苷类药物的糖、苷元的种类以及苷元和糖的连接方式有关。如强心苷易水解，故常以较高浓度的乙醇为溶剂，其注射剂多采用水与乙醇、丙二醇或甘油等混合溶剂。